男，42岁，2年前出现左下肢行走10余分钟后胀痛。休息片刻缓解，再行走后疼痛又出现。无吸烟史，发病前半年左足部外伤已治愈，体格检查：左下肢皮色较苍白，左足背动脉未触及。最可能的诊断是
A. 动脉粥样硬化性闭塞症
B. 血栓闭塞性脉管炎
C. 雷诺病
D. 多发性大动脉炎
E. 结节性动脉周围炎

正确答案：B。血栓闭塞性脉管炎

解析：青年男性患者（血栓闭塞性脉管炎好发人群），2年前出现左下肢行走10余分钟后胀痛，休息片刻缓解，再行走后疼痛又出现（间歇性跛行，提示下肢远端供血不足）。体查：左下肢皮色较苍白，左足背动脉未触及（提示下肢远端供血不足）。综合该患者的病史及体查，最可能的诊断是血栓闭塞性脉管炎（B对）。动脉粥样硬化性闭塞症（P487）（A错）多见于45岁以上患者，患者常有高脂血症、高血压、糖尿病、吸烟等高危因素，早期表现为患肢麻木、发凉及色泽苍白，随病变发展可出现间歇性跛行及静息痛。雷诺病（P493）（C错）多见于青壮年女性，好发于手指，典型表现为受累部位依次出现苍白、青紫、潮红，患肢远端动脉搏动正常。多发性大动脉炎（P491）（D错）好发于青年女性，是主动脉及其分支的慢性、多发性、非特异性炎症，造成罹患动脉狭窄或闭塞，疾病的早期或活动期常有低热、乏力、肌肉或关节疼痛等症状。结节性动脉周围炎（E错）主要表现为体重下降、发热、乏力、周围神经病变、肾损害、骨骼肌和皮肤损害、高血压、胃肠道损害、心力衰竭等症状。